属于丙类传染病的病种是
A. 艾滋病
B. 肺结核
C. 传染性非典型肺炎
D. 人感染高致病性禽流感
E. 流行性和地方性斑疹伤寒

正确答案：E。流行性和地方性斑疹伤寒

解析：丙类传染病包括：流行性感冒、流行性腮腺炎、风疹、急性出血性结膜炎、麻风病、流行性和地方性斑疹伤寒（E对）、黑热病、包虫病、丝虫病，除霍乱、细菌性和阿米巴性痢疾、伤寒和副伤寒以外的感染性腹泻病。艾滋病（A错）、肺结核（B错）、传染性非典型肺炎（C错）、人感染高致病性禽流感（D错）均为乙类传染病。